非流行期间流行性脑脊髓膜炎的主要传染源是
A. 患者
B. 带菌者
C. 慢性感染者
D. 隐性感染者
E. 带菌动物

正确答案：B。带菌者

解析：带菌者和流脑患者是流行性脑脊髓膜炎的传染源。非流行期间带菌者（B对）为主要传染源；流脑患者（A错）从潜伏期开始至病后10天内具有传染性，因此流行期间感染率高。流行性脑脊髓膜炎为急性感染无慢性感染者（C错）。本病隐性感染率（D错）在流行期间高，流行期间人群带菌率可高达50%，A群带菌率可达30%～50% 。病后带菌者约为10%～20% ，超过3个月为慢性带菌，病原菌存在于带菌者鼻咽部深层淋巴组织内，且多为耐药菌株，因无症状不易被发现，而患者经治疗后细菌很快消失，故带菌者作为传染源的意义更重要。另外本病主要通过咳嗽、喷嚏等飞沫由呼吸道直接传播，所以带菌动物（E错）不是传染源。